若测得某物质的肾清除率为80ml/min，则可认为肾小管对该物质
A. 必定能重吸收，但不能确定能否分泌
B. 必定能分泌，但不确定能否重吸收
C. 必定能重吸收，也必定能分泌
D. 必定不能重吸收，也必定不能分泌
E. 能否重吸收和分泌都不能确定

正确答案：A。必定能重吸收，但不能确定能否分泌

解析：该物质的肾清除率为80ml/min（小于肾小球的滤过率125ml/min），可以肯定该物质必定在肾小管被重吸收，但不能排除它也能被肾小管分泌的可能性，因为当重吸收量大于分泌量时，其清除率仍小于肾小球滤过率（A对）。必定能分泌，但不确定能否重吸收时（B错），物质的清除率应该大于肾小球的滤过率125ml/min。必定能重吸收，也必定能分泌（C错）时，物质的清除率不能确定。必定不能重吸收，也必定不能分泌（D错）时，物质的清除率为肾小球的滤过率。本题中物质的肾清除率小于肾小球的滤过率，可以确定肾小管对该物质肯定重吸收，能否重吸收和分泌都不能确定（E错）为错误选项。